患者，女，56岁，反复发热半年，为低热，发热而欲近衣，形寒怯冷，四肢不温，少气懒言，头晕嗜卧，腰膝酸软，纳少便溏，苔白润，脉沉细无力，其治法是
A. 温补阳气，引火归元
B. 补中益气，甘温除热
C. 滋补肾阴，清热泻火
D. 滋补肝肾，清退虚热
E. 补气养阴，清退虚热

正确答案：A。温补阳气，引火归元

解析：根据患者“发热半年，为低热”，辨为“内伤发热”，根据“发热而欲近衣，形寒怯冷，四肢不温，少气懒言，头晕嗜卧，腰膝酸软，纳少便溏，苔白润，脉沉细无力”，辨为“阳虚发热证”。患者肾阳亏虚，火不归原，治宜温补阳气，引火归元（A对），方选金匮肾气丸加减。